泽泻的主产地是
A. 河北
B. 河南
C. 四川
D. 福建
E. 广东

正确答案：D。福建